根据《处方管理办法》，药学专业技术人员调剂处方时必须做到“四查十对”，查配伍禁忌是指
A. 对药品性状、用法用量
B. 对临床诊断
C. 对科别、姓名、年龄
D. 对药名、剂型、规格、数量
E. 对价格收费

正确答案：A。对药品性状、用法用量

解析：本题考查的是处方的“四查十对”原则。根据《处方管理办法》，药学专业技术人员调剂处方时必须做到“四查十对”，查配伍禁忌是指对药品性状、用法用量（A对）。处方的“四查十对”原则：药师调剂处方时必须做到“四查十对”：查处方，对科别、姓名、年龄（C错）；查药品，对药名、剂型、规格、数量（D错）；查配伍禁忌，对药品性状、用法用量；查用药合理性，对临床诊断（B错）。